骨骼中铅的主要存在形式为
A. 氧化铅
B. 可溶性磷酸氢铅
C. 不溶性磷酸氢铅
D. 可溶性磷酸铅
E. 不溶性磷酸铅

正确答案：E。不溶性磷酸铅